口腔卫生状况检查中，对牙石及软垢的检查，“++”代表
A. 无牙石和软垢
B. 牙石或软垢附着在颈部不足牙冠的1/3
C. 牙石或软垢附着超过牙冠的1/3，但不足2/3
D. 牙石或软垢附着超过牙冠的2/3
E. 牙石或软垢附着超过牙冠的3/4

正确答案：C。牙石或软垢附着超过牙冠的1/3，但不足2/3

解析：牙石及软垢的检查：观察牙石及软垢是否存在、量的多少，以及其分布。临床上常用“+”、“++”、“+++”表示，“+”表示牙石或软垢附着在颈部不足牙冠的1/3；“++”表示附着超过1/3，但不足2/3；“+++”表示附着超过牙冠的2/3。掌握“牙周疾病检查”知识点。